蓄积作用是
A. 化学物质发生慢性中毒的基础
B. 分为物质蓄积和功能蓄积
C. 是化学毒物分布的一种特殊形式
D. 多来自小剂量的长期接触
E. 以上均正确

正确答案：E。以上均正确